社会医学是
A. 社会科学的一门分支学科
B. 理论学科
C. 临床医学的分支学科
D. 交叉学科，边缘学科
E. 以上答案均不是

正确答案：D。交叉学科，边缘学科

解析：本题考查社会医学。社会医学是从社会的角度研究医学和健康问题的一门交叉学科，也是医学和社会学之间的一门新兴的边缘学科（D对ABCE错），它研究社会因素与个体及群体健康和疾病之间相互作用及其规律，制定相应的社会策略和措施，保护和增进个体及人群的身心健康和社会活动能力，提高生命质量，充分发挥健康的社会功能，提高人群的健康水平。